由A族溶血性链球菌引起的疾病是
A. 麻疹
B. 风疹
C. 幼儿急疹
D. 咽-结合膜热
E. 猩红热

正确答案：E。猩红热